有关胸导管的描述，何者为错？
A. 平第一腰椎起自乳糜池
B. 由左右腰干汇合而成
C. 是全身最大的淋巴管
D. 以主动脉裂孔入胸腔
E. 注入左静脉角

正确答案：B。由左右腰干汇合而成

解析：胸导管平第一腰椎起自乳糜池（A对）。由左右腰干汇合而成乳糜池（B错，为本题正确答案）。是全身最大的淋巴管（C对）。经主动脉裂孔进入胸腔（D对）。注入左静脉角（E对）。